抗凝血灭鼠剂导致人畜中毒时，下列哪种药物是有效解毒剂
A. 阿托品
B. 维生素B
C. 维生素C
D. 维生素K
E. 维生素A

正确答案：D。维生素K